第3位密码子与第1位反密码子之间的配对并不严格指的是
A. 方向性
B. 连续性
C. 简并性
D. 通用性
E. 摆动性

正确答案：E。摆动性

解析：遗传密码具有以下重要特点：方向性（5’→3’）；连续性（密码子及密码子的各碱基之间没有间隔）；简并性（一种氨基酸可具有两个或两个以上的密码子）；通用性（遗传密码基本上适用于生物界的所有物种）；摆动性（第3位密码子与第1位反密码子之间的配对并不严格）。掌握“蛋白质的生物合成”知识点。